根据藏象理论，在吸收水谷精微的同时，也吸收大量水液，泌别清浊，所属脏腑功能是
A. 肺通调水道
B. 脾运化水液
C. 肾主水液
D. 小肠主液
E. 大肠主津

正确答案：D。小肠主液

解析：本题考查的是小肠的生理功能。根据藏象理论，在吸收水谷精微的同时，也吸收大量水液，泌别清浊，所属脏腑功能是小肠主液（D对）。小肠主液：小肠在吸收水谷精微的同时，也吸收了大量的水液，使无用的水液渗入于膀胱，故称“小肠主液”。大肠居于下腹中，其上口在阑门处与小肠相接，其下端紧接肛门（又称魄门）。肺通调水道（A错）：是指肺气宣发和肃降对于体内津液代谢具有疏通和调节的作用。脾运化水液（B错）：是指脾对水液的吸收、转输和布散作用。肾主水液（C错）：是指肾的气化功能，对于体内津液的输布和排泄，维持津液代谢平衡，起着极为重要的调节作用。大肠主津（E错）：大肠接受经过小肠泌别清浊后传输而来的食物残渣，吸收其中多余的水液，形成粪便，经肛门而排出体外，故称“大肠主津”。